某地流感暴发流行，经调查该地3789人中当月有837人发生流感，这些人中有14人曾在一个月前发生过感冒，计算得837/3789＝22.1%，这个率应是
A. 罹患率
B. 患病率
C. 发病率
D. 续发率
E. 感染率

正确答案：A。罹患率

解析：本题考查罹患率的应用。题干说的是暴发流行，此处应使用罹患率，而不是发病率。罹患率是测量某人群某病新病例发生频率的指标，通常指在某一局限范围短时间内的发病率。本题中，837名患者中有14人一月前曾患过感冒，由于感冒的病程短，病后免疫不巩固，因此，可以认为这14人在此次流感暴发中属于痊愈后再感，在计算罹患率时不应将其从分子分母中扣除。经计算得837/3789＝22.1%，这个率应是罹患率（A对BCDE错）。